齐墩果酸结构类型是
A. 螺旋甾烷醇型
B. β-香树脂醇型
C. α-香树脂醇型
D. 羽扇豆醇型
E. 达玛烷型

正确答案：B。β-香树脂醇型

解析：本题考查的是三萜的分类。齐墩果酸结构类型是β-香树脂醇型（B对）。三萜：基本骨架由6个异戊二烯单位组成。三萜的种类很多，但以皂苷形式存在的三萜类型并不多，较为常见的有羊毛甾烷型、达玛烷型、齐墩果烷型、乌苏烷型和羽扇豆烷型，其中前两种属于四环三萜，后三种则属于五环三萜。1.四环三萜：结构与甾醇很类似。主要有以下类型。（1）羊毛甾烷型，如猪苓酸A。（2）达玛烷型（E错），如20（S）-原人参二醇。2.五环三萜：主要有以下类型。（1）齐墩果烷型：又称β-香树脂烷型，此类以齐墩果酸最为多见。（2）乌苏烷型：又称α-香树脂烷型（C错）或熊果烷型，此类大多是乌苏酸的衍生物。（3）羽扇豆烷型（D错）：如羽扇豆种子中存在的羽扇豆醇，酸枣仁中分得的白桦醇和白桦酸等。螺旋甾烷醇（A错）属于甾体皂苷。甾体皂苷与三萜皂苷相似，均由甾体皂苷元与糖组成，这是天然广泛存在的一类化学成分。甾体皂苷分类主要有螺旋甾烷醇类、异螺旋甾烷醇类、呋甾烷醇类和变形螺旋甾烷醇类。1.螺旋甾烷醇和异螺旋甾烷醇类：螺旋甾烷有菝葜皂苷元和剑麻皂苷元等；异螺旋甾烷有薯蓣皂苷元和沿阶草皂苷D苷元等。2.呋甾烷醇类：有原蜘蛛抱蛋皂苷等。3.变形螺旋甾烷醇类：有燕麦皂苷B等。